对疑似甲类传染病患者予以隔离所体现的公共卫生伦理原则是
A. 社会公益原则
B. 互助协同原则
C. 信息公开原则
D. 社会公正原则
E. 全社会参与原则

正确答案：A。社会公益原则

解析：社会公益原则（A对）是指应将社会公共利益置于优先考虑的位置，并兼顾个人权利与健康福利，要坚持个人利益服从社会利益，坚持局部利益服从全局利益、眼前利益服从长远利益。互相协同原则（B错）是指医院、公安机关及各级人民政府相互协调与合作，以保证防治工作有序进行。信息公开原则（C错）是指地方各级人民政府对于已经发生的疫情及可能发生的疫情需要及时进行通报。社会公正原则（D错）是指在传染病的防治中，各方均应履行自己的职责，若其中一方未依法履行职责的，需要接受法律的制裁。全社会参与原则（E错）是指公共卫生工作必须依靠全社会的广泛参与才能实现。